女，9个月，体重8kg，发热，呕吐，腹泻3天，粪便蛋花汤样，无腥臭味，尿量明显少，精神萎靡，皮肤弹性差，眼凹陷，唇樱红，四肢凉，诊断为婴儿腹泻，血钠132mmol/L。第一天补液种类应选择
A. 2：1液
B. 2：3：1液
C. 维持液
D. 1.4%碳酸氢钠
E. 10%葡萄糖液

正确答案：B。2：3：1液

解析：2：3：1液是由0.9%氯化钠溶液、5%或10%葡萄糖溶液、1.4%碳酸氢钠溶液或1.87%乳酸钠溶液，按照2：3：l的体积比混合配制而成的1/2张含钠液，适用于等渗性脱水患儿的补液。患儿血钠132mmol/L（正常值为130～150mmol/L），结合患儿的临床表现，可见该患儿为腹泻病（P251）、等渗性中度脱水，且不能排除代谢性酸中毒，因此2：3：1液（B对）是该患儿最佳的补液选择。2：1液（A错）是由0.9%氯化钠溶液、1.4%碳酸氢钠溶液或1.87%乳酸钠溶液，按照2：1的体积比混合配制而成的等张含钠液。生理维持液（C错）即0.9%氯化钠溶液、10%葡萄糖溶液，10%氯化钾溶液的混合溶液，张力为1/3张，适用于高渗性脱水的患儿。1.4%碳酸氢钠（D错）为等张含钠碱性液，脱水时一般不会单独应用，10%葡萄糖液（E错）属于高渗的胶体溶液，一般用于低血糖患儿，脱水患儿单独应用可能会加重细胞内失水，进一步加重脱水。